男，20岁。1型糖尿病病史10年，平时每日4次胰岛素强化治疗。近2日发热，咽痛,食欲不振，进食少，自行停用胰岛素。晨起家属发现患者不能正确回答问题，急诊就诊，查体:T38.5°C,精神差，轻度脱水貌。实验室检查:血钠140mmol/L，血钾4.5mmol/L，血糖25mmol/L，血pH7.26，尿酮体（+++）。最有可能有异常的检查是
A. 胰岛素
B. 生长激素
C. 胰岛素释放试验和C肽释放试验
D. 甲状腺激素
E. 促甲状腺激素

正确答案：A。胰岛素

解析：1型糖尿病胰岛β细胞破坏，常导致胰岛素绝对缺乏，所以该患者最可能有异常的检查时胰岛素。